主要侵害视神经，导致视网膜受损，视神经萎缩，视力减退和双目失明的是
A. 甲醇
B. 甲醛
C. 铅
D. 锰
E. 氢氰酸

正确答案：A。甲醇

解析：本题考查甲醇中毒。甲醇（A对BCDE错）主要侵害视神经，导致视网膜受损、视神经萎缩、视力减退和双目失明。